去甲肾上腺素的药理作用是
A. 增加肾血流量
B. 增加冠状动脉血流量
C. 收缩小静脉和小动脉
D. 缩小瞳孔
E. 降低血糖

正确答案：C。收缩小静脉和小动脉

解析：本题考查去甲肾上腺素的药理作用。去甲肾上腺素是强α受体激动药，对β₁受体作用较弱，对β₂受体几无作用。通过α受体的激动作用，可引起小动脉和小静脉血管收缩（C对）。